小儿动脉收缩压应用下列哪项公式计算
A. （年龄×2）+85
B. （年龄×2）+80
C. （年龄×5）+85
D. （年龄×2）+75
E. 以上都不是

正确答案：B。（年龄×2）+80